可治疗伤寒的青霉素类药是
A. 苄青霉素
B. 苯唑西林
C. 羧苄西林
D. 替卡西林
E. 氨苄西林

正确答案：E。氨苄西林

解析：氨苄西林的抗菌作用及临床应用：对G-杆菌有较强的抗菌作用，如对伤寒沙门菌、副伤寒沙门菌、百日咳鲍特菌、大肠埃希菌、痢疾志贺菌等均有较强的抗菌作用，对铜绿假单胞菌无效，对粪链球菌作用优于青霉素G。临床用于治疗敏感菌所致的呼吸道感染、伤寒、副伤寒、尿路感染、胃肠道感染、软组织感染、脑膜炎、败血症、心内膜炎等。掌握“青霉素及头孢菌素类药”知识点。